抗利尿激素的作用部位是
A. 近曲小管和远曲小管
B. 髓袢降支和远曲小管
C. 髓袢升支和远曲小管
D. 近曲小管和集合管
E. 远曲小管和集合管

正确答案：E。远曲小管和集合管

解析：抗利尿激素（ADH）可作用于肾远曲小管和集合管（E对），加强肾远曲小管和集合管对水的重吸收，减少水的排出。当体内水分过少或摄盐过多引起细胞外渗透压增高时，可促使抗利尿激素分泌增多；反之当体内水分过多或摄盐不足而使细胞外渗透压降低时，可抑制抗利尿激素的分泌而增加水的排出。